主动脉瓣关闭发生于
A. 快速射血期开始时
B. 快速充盈期开始时
C. 等容舒张期开始时
D. 等容收缩期开始时
E. 减慢充盈期开始时

正确答案：C。等容舒张期开始时